龋病患者的温度刺激反应程度较重，洞底软龋能彻底去净，最佳的治疗方法是
A. 双层垫底，一次完成充填治疗
B. 局麻下开髓失活，行牙髓治疗
C. 先安抚，待1～2周复诊后症状消除，再行垫底充填
D. 实行活髓切断术
E. 间接盖髓、双层垫底，一次完成充填治疗

正确答案：C。先安抚，待1～2周复诊后症状消除，再行垫底充填

解析：龋病患者的主观临床症状较明显，仍为温度刺激痛性质，程度较重，洞底软龋能彻底去净，但极近髓，甚至髓角已透红，可先用氧化锌丁香油糊剂做安抚疗法或行间接盖髓，待1～2周复诊症状消除后，再行复合树脂粘接修复或垫底充填。若症状未能缓解，需再进一步检查，考虑是否需做牙髓治疗。掌握“龋病的治疗原则与非手术治疗方法”知识点。